为两种解热镇痛药结合的化合物，对胃肠的刺激性较小的是
A. 布洛芬
B. 对乙酰氨基酚
C. 阿司匹林
D. 吲哚美辛
E. 贝诺酯

正确答案：E。贝诺酯

解析：本题考查贝诺酯。为两种解热镇痛药结合的化合物，对胃肠的刺激性较小的是贝诺酯（E对）。贝诺酯为对乙酰氨基酚与阿司匹林的酯化物，具有解热，镇痛及抗炎作用，特点是较少引起胃肠道出血，患者易于耐受，作用时间比阿司匹林或对乙酰氨基酚长。体内分解为两种解热镇痛药、对胃肠刺激较小、作用时间长。布洛芬（A错）为芳基丙酸类非甾体抗炎药，对胃肠道的不良反应较轻，易于耐受，为此类药物中对胃肠刺激性最低的。对乙酰氨基酚（B错）为乙酰苯胺类解热镇痛药，对胃无刺激性，剂量过大可引起肝脏损害，严重者可致昏迷甚至死亡。阿司匹林（C错）为水杨酸类解热镇痛药，吲哚美辛（D错）为芳基乙酸类抗炎药，两者均有胃肠道的不良反应。